某女，78岁。患高血压病10年，因感冒发热1天就诊于中医。症见发热、微恶风塞、咳嗽、头痛眩晕、目赤翳障、咽喉肿痛、便秘，舌红苔薄黄，脉浮数，医师诊断为风热感冒、肝阳上亢兼有肠热，遂决定以桑叶配菊花为基础进行组方。医师以桑叶配菊花作为基础进行组方，是因为二药均能
A. 疏散风热，清热解毒
B. 疏散风热，清肺润燥
C. 清热解毒，平肝明目
D. 疏散风热，平肝明目
E. 清热解毒，清肺润燥

正确答案：D。疏散风热，平肝明目

解析：本题考查的是桑叶和菊花的功效。以桑叶配菊花作为基础进行组方，是因为二药均能疏散风热，平肝明目（D对）。桑叶：【功效】疏散风热，清肺润燥（B错），平肝明目，凉血止血。菊花：【功效】疏散风热，平肝明目（D错），清热解毒（AC错）。